最易形成慢发病毒感染的病原体是
A. HIV
B. HBV
C. HAV
D. HSV
E. HHV-6

正确答案：A。HIV

解析：慢发病毒感染是病毒在显性或者隐性感染后，病毒有很长的潜伏期，可达数月，数年甚至数十年。在症状出现后呈进行加重，最终导致死亡，如HIV（A对）引起的艾滋病、麻疹病毒引起的亚急性硬化性全脑炎、狂犬病毒及朊粒感染引起的疾病等。HBV（乙型肝炎）（B错）、丙型肝炎（HCV）可引起表现轻微或无临床症状但常反复发作、迁延不愈的慢性感染（P225）。HAV（甲型肝炎病毒）（C错）感染可表现为显性感染或隐性感染，成人多因隐性感染而获得免疫力。HSV（单纯疱疹病毒）（D错）、HHV-6（人疱疹病毒6型）（E错）主要引起潜伏感染（P225）。